男，50岁。乏力，腹胀伴尿黄1月余，15年前检查HBsAg（+），肝功能反复异常，但未诊治。既往有食管胃底静脉曲张破裂出血史。查体：皮肤巩膜重度黄染，肝掌及蜘蛛痣（+），腹水征（+）。实验室检查：ALT250U/L，TBil320µmoI/L，HBsAg（+），PTA18％。最可能的诊断是
A. 慢性肝炎急性发作
B. HBsAg携带者
C. 慢性肝衰竭
D. 急性肝衰竭
E. 亚急性肝衰竭

正确答案：C。慢性肝衰竭

解析：中年男性患者，HBsAg（+）（乙肝感染史），既往有食管胃底静脉曲张破裂出血史（肝炎致肝硬化史）。乏力，腹胀伴尿黄1月余，查体：皮肤巩膜重度黄染，肝掌及蜘蛛痣（+），腹水征（+）。实验室检查：ALT250U/L（正常值＜40U/L，提示存在肝功能损伤），TBil320µmoI/L（黄疸进行性加深，正常高值为17.1mmol/L），HBsAg（+），PTA18％（血浆凝血酶原活动度（PTA）≤40%）。综合患者的病史、临表、实验室检查，考虑诊断为慢性肝衰竭（C对AB错）。急性肝衰竭（D错）起病2周内发生肝衰竭。（P41）在慢性肝病基础上出现的急性肝功能失代偿为慢加急性 （亚急性）肝衰竭（E错）。在慢性肝炎或肝硬化基础上出现的重型肝炎为慢性肝衰竭。